动式染毒主要优点是
A. 装置备有新鲜空气补充
B. 受试化合物保持浓度不变
C. 保证染毒柜内和二氧化碳分压恒定
D. 温湿度恒定
E. 以上都是

正确答案：E。以上都是